《城镇职工基本医疗保险定点零售药店管理暂行办法》规定，定点零售药店对外配处方要
A. 与药品分类管理的处方药合并管理
B. 加强管理、统一核算
C. 集中管理、统一记账
D. 分别管理、单独建账
E. 分别管理、统一核算

正确答案：D。分别管理、单独建账